四逆散与四逆汤的组成中均含有药物是
A. 茯苓
B. 附子
C. 白术
D. 甘草
E. 人参

正确答案：D。甘草

解析：四逆散功能透邪解郁，疏肝理脾，由甘草、枳实、柴胡、白芍组成。四逆汤功能回阳救逆，由甘草、干姜、附子组成。故四逆散与四逆汤均含有的药物为甘草（D对）。记忆：四逆散，四逆散中用柴胡，芍药枳实甘草须。四逆汤，四逆只服干草。